治疗新生儿缺氧缺血性脑病控制惊厥首选
A. 苯巴比妥
B. 地西泮
C. 水合氯醛
D. 氯丙嗪
E. 苯妥英钠

正确答案：A。苯巴比妥

解析：治疗新生儿缺氧缺血性脑病控制惊厥首选苯巴比妥（A对），而地西泮（B错）主要用于焦虑症、失眠、癫痫等疾病，水合氯醛（C错）主要用于失眠烦躁不安及惊厥，氯丙嗪（D错）主要用于治疗精神病、镇吐、低温麻醉及人工冬眠等，苯妥英钠（E错）主要用于癫痫及心律失常的治疗。